肝颈静脉回流征阳性主要见于
A. 左心衰
B. 肝硬化
C. 心包积液
D. 急性心肌梗死
E. 肾功能不全

正确答案：C。心包积液

解析：肝颈静脉回流征指右心衰竭的病人，如按压其肿大的肝脏时，则颈静脉充盈更为明显，称肝颈静脉回流征，最常见的原因就是右心功能不全、右心衰。右心衰时，因右心房淤血或右心室舒张受限，不能完全接受回流血量，而致颈静脉充盈更为明显。肝颈静脉回流征阳性主要见于心包积液（C对）。